属于易氧化的药物是
A. 药用炭
B. 碳酸氢钠
C. 甲丙氨酯
D. 酚磺乙胺
E. 甘油

正确答案：D。酚磺乙胺